败毒散与参苏饮组成中均含有的药物是
A. 人参苏叶
B. 人参羌活
C. 半夏茯苓
D. 枳壳前胡
E. 生姜薄荷

正确答案：D。枳壳前胡

解析：败毒散与参苏饮均含人参以益气，枳壳、桔梗以宣降肺气，前胡以化痰止咳，茯苓以健脾渗湿消痰，均可治疗气虚外感风寒。但是，败毒散所治为风寒夹湿之表证为主，其气虚程度不重，故以羌活、独活、川芎、柴胡祛邪为主；而参苏饮气虚程度较重，故用苏叶、葛根、人参益气解表为主，加之痰湿与气滞亦甚，则又增半夏、木香、陈皮等化痰行气之品。故败毒散与参苏饮均含人参、枳壳、桔梗、前胡、茯苓、甘草（D对）。